为补充体内铁的储存量，营养性缺铁性贫血口服铁剂应维持到
A. 血红蛋白正常后1个月停药
B. 血红蛋白正常后2个月停药
C. 血红蛋白正常后5个月停药
D. 血红蛋白正常后3个月停药
E. 血红蛋白正常后4个月停药

正确答案：C。血红蛋白正常后5个月停药

解析：缺铁性贫血是由于机体对铁的供给和需求失衡，导致体内贮存铁耗尽，继之红细胞内铁缺乏，最终引起缺铁性贫血。铁剂治疗时，首先表现为外周网织红细胞增高，2周后血红蛋白升高并通常在2个月左右恢复正常，但此时的细胞外贮存铁并未得到补充，仍需在血红蛋白恢复正常后再持续4-6个月，待铁蛋白正常后停药（C对）。因此此题最佳答案为C选项。